大柴胡汤的功用是
A. 和解少阳、内泻热结
B. 和胃降逆、开结除痞
C. 清胆利湿、和胃化痰
D. 寒热平调、消痞散结
E. 滋阴清热、养血安神

正确答案：A。和解少阳、内泻热结

解析：大柴胡汤中柴胡为君，疏解少阳之邪。黄芩清泄少阳郁热，与柴胡相伍，和解清热，以解少阳之邪。大黄、枳实泻热通腑，行气破结，内泻阳明热结。芍药缓急止痛，与大黄相配可治腹中实痛，合枳实能调和气血，以除心下满痛；半夏和胃降逆，辛开散结；配伍生姜，既增止呕之功，又解半夏之毒。大枣和中益气，与生姜相配，调脾胃、和营卫，并调和诸药。诸药合用，既不悖少阳禁下原则，又可和解少阳、内泻热结（A对），使少阳与阳明之邪得以分解。